提供虚假材料申请药品广告审批被药品广告审查机关在受理审查中发现的，应给予的处罚包括
A. 3年内不受理该企业的同类药品广告审批申请
B. 1年内不受理该企业该品种的药品广告审批申请
C. 1年内不受理该企业的所有药品广告审批申
D. 3年内不受理该企业该品种的药品广告审批申

正确答案：C。1年内不受理该企业的所有药品广告审批申

解析：本题考查违反药品广告管理的处罚。提供虚假材料申请药品广告审批被药品广告审查机关在受理审查中发现的，应给予的处罚包括1年内不受理该企业该品种的药品广告审批申请（C对）。违反药品广告管理以不当方式获得批准文件的处罚：隐瞒真实情况或者提供虚假材料申请药品、医疗器械、保健食品和特殊医学用途配方食品广告审查的；或者以欺骗、贿赂等不正当手段取得药品、医疗器械、保健食品和特殊医学用途配方食品广告批准文号的，按照《广告法》第六十五条处罚，广告审查机关不予受理或者不予批准，予以警告，一年内不受理该申请人的广告审查申请（B错）；以欺骗、贿赂等不正当手段取得广告审查批准的，广告审查机关予以撤销，处十万元以上二十万元以下的罚款，三年内不受理该申请人的广告审查申请（AD错）。